生长激素幼年时分泌不足，可引起
A. 巨人症
B. 肢端肥大症
C. 侏儒症
D. 尿量减少
E. 乳腺发育与乳腺分泌

正确答案：C。侏儒症

解析：成年之前，垂体生长激素分泌亢进会促使骨过度生长导致巨人症；若分泌不足，则发育停滞导致侏儒症（C对）。